磺胺甲噁唑+甲氧苄啶，合并用药的目的是
A. 提高药物疗效
B. 减少不良反应
C. 治疗多种疾病
D. 延缓细菌耐药
E. 减少经济负担

正确答案：A。提高药物疗效

解析：本题考查药物的联合应用。磺胺甲噁唑+甲氧苄啶，合并用药的目的是提高药物疗效（A对）。磺胺类药物与对氨基苯甲酸化学结构相似，可与对氨基苯甲酸竞争二氢叶酸合成酶，阻止细菌二氢叶酸的合成；甲氧苄啶作用机制为抑制细菌二氢叶酸还原酶，导致四氢叶酸生成减少，因而阻止细菌核酸合成。甲氧苄啶与磺胺类药物合用时，两者双重阻断细菌四氢叶酸的合成而产生显著的协同抑菌效应，从而提高药物的疗效。